注射液污染热原的途径有
A. 从注射用水中带入
B. 从其他原辅料中带入
C. 从容器、用具、管道和设备等带人
D. 从制备环境中带入
E. 从输液器带入

正确答案：A、B、C、D、E。从注射用水中带入；从其他原辅料中带入；从容器、用具、管道和设备等带人；从制备环境中带入；从输液器带入

解析：本题考查注射液污染热原的途径。注射液污染热原的途径有：（1）溶剂带入（A对）：这是注射剂被热原污染的主要途径。如注射用水在制备时操作不当或蒸熘水器结构不合理，或贮存时间较长都有可能使蒸熘水中带有热原。（2）原辅料带入（B对）：原辅料本身质量不符合要求，则易受到微生物污染而导致热原产生。（3）容器或用具带入（C对）：制备无菌制剂的用具、管道、装置、灌装容器，如果未按GMP要求认真清洗处理，均易使药液污染而导致热原产生。（4）制备过程带入（D对）：制备过程中洁净度不符合无菌制剂的要求，操作时间过长，产品灭菌不及时或不合格，工作人员未严格执行操作规程，这些因素都会增加微生物的污染机会而产生热原。（5）使用过程带入：由于注射器具的污染而造成的不良后果（E对）。